患者，女性，22岁。突然发热，腰痛，卧床不起，尿蛋白（-），红细胞10/HP，白细胞20～30/HP。下列哪项不符合急性肾盂肾炎
A. 发热
B. 尿白细胞管型
C. 膀胱刺激征
D. 高血压
E. 肾区叩痛

正确答案：D。高血压

解析：本题考查急性肾盂肾炎。高血压（D错，为本题的正确答案）除原发性外，可引起继发性高血压的肾脏疾病有肾小球肾炎、慢性肾盂肾炎、肾动脉狭窄等。患者，女性，22岁。突然发热，腰痛，卧床不起，尿蛋白（-），红细胞10/HP，白细胞20～30/HP，应考虑诊断为急性肾盂肾炎。急性肾盂肾炎的临床表现包括（1）全身症状：发热（A对）、寒战、头痛、全身酸痛、恶心、呕吐等，体温多在38.0℃以上，多为弛张热，也可呈稽留热或间歇热。部分患者出现革兰阴性杆菌败血症。（2）泌尿系统症状：尿频、尿急、尿痛（膀胱刺激征）（C对）、排尿困难、下腹部疼痛、腰痛等。腰痛程度不一，多为钝痛或酸痛。部分患者膀胱刺激症状不典型或缺如。（3）体格检査：除发热、心动过速和全身肌肉压痛外，还可发现一侧或两侧肋脊角或输尿管点压痛和（或）肾区叩击痛（E对）。常规检查可见尿液常混浊，可有异味，可有白细胞尿、血尿、蛋白尿部分肾盂肾炎患者尿中可见白细胞管型（B对）。